婴儿腹泻的治疗原则不包括
A. 调整和适当限制饮食
B. 纠正水、电解质紊乱
C. 加强护理，防止并发症
D. 控制肠道内外感染
E. 长期应用广谱抗生素

正确答案：E。长期应用广谱抗生素

解析：病毒性及非侵袭性链球菌感染细菌所致，一般不用抗生素，应合理使用液体疗法，选用微生态制剂和黏膜保护剂，但对重症患儿、新生儿、小婴儿和免疫功能低下的患儿应选用抗生素，根据大便培养和药敏实验结果进行调整，长期应用广谱抗生素属于滥用抗生素，违背合理用药的原则，容易出现难治性肠道菌群失调所致的腹泻（E错，为本题正确答案）。调整和适当限制饮食（A对）可减轻胃肠道负担，保证机体生理需要量。纠正水、电解质紊乱（B对）有助于防止脱水，恢复肾循环和肾功能，是降低病死率的关键。加强护理，防止并发症（C对）和控制肠道内外感染（D对）可避免病情加重，使疾病复杂化。